琥珀的功效是
A. 定惊安神
B. 宁心安神
C. 解郁安神
D. 补气安神
E. 养心安神

正确答案：A。定惊安神

解析：本题考查琥珀的功效。琥珀的功效是定惊安神（A对）。琥珀【功效】安神定惊，活血散瘀，利尿通淋。景天三七【功效】化瘀止血，宁心安神（B错），解毒。合欢皮【功效】解郁安神（C错），活血消肿。刺五加【功效】补气（D错）健脾，益肾强腰，养心安神（E错），活血通络。